下列不是病例对照研究特点的是
A. 省力省钱
B. 适合罕见病的病因研究
C. 可从所得结果估计相对危险度
D. 可直接计算归因危险度
E. 所选对照为未患所研究疾病者

正确答案：D。可直接计算归因危险度